指定传染病不包括
A. 艾滋病
B. 淋病
C. 梅毒
D. 麻风病
E. 医学上认为不影响结婚和生育的其他传染病在传染期内

正确答案：E。医学上认为不影响结婚和生育的其他传染病在传染期内

解析：本题考查婚前医学检查的指定传染病。在婚前医学检查的指定传染病（E错，为本题正确答案）包括筛查：病毒性肝炎、结核、淋病（B对）、梅毒（C对）、麻风病（D对）、尖锐湿疣、生殖器疱疹以及艾滋病（A对）。